肾脏在胎儿期合成较多的激素是
A. 前列腺素
B. 肾素
C. 1，25-（OH）₂D₃
D. 促红细胞生成素
E. 利钠激素

正确答案：D。促红细胞生成素

解析：由于胎儿血氧分压较低，故胚肾合成促红细胞生成素较多，生后随着血氧分压的增高，促红细胞生成素合成减少（D对）。前列腺素（A错）、肾素（B错）、1，25-（OH）₂D₃（C错）、利钠激素（E错）均为新生儿期水平较高。